能杀虫止痒的药是
A. 通草
B. 瞿麦
C. 茵陈
D. 萆薢
E. 萹蓄

正确答案：E。萹蓄

解析：本题考查的是萹蓄的功效。能杀虫止痒的药是萹蓄（E对）。萹蓄：【功效】利尿通淋，杀虫止痒。通草（A错）：【功效】利水清热，通气下乳。瞿麦（B错）：【功效】利尿通淋，破血通经。茵陈（C错）：【功效】清热利湿，退黄。萆薢（D错）：【功效】利湿浊，祛风湿。